符合继发性腹膜炎腹痛特点的是
A. 阵发性全腹绞痛
B. 剧烈，持续性全腹痛
C. 逐渐加重的阵发性腹痛
D. 疼痛与进食有关
E. 高热后全腹痛

正确答案：B。剧烈，持续性全腹痛

解析：继发性腹膜炎多由腹腔空腔脏器穿孔或实质性脏器破裂所致。空腔脏器内容物（如胃液、胆汁）、血液等漏入腹腔，持续刺激腹膜，可引起剧烈的、难以忍受的持续性全腹痛（B对）。阵发性全腹绞痛（A错）为胆囊结石或泌尿系结石的疼痛特点。逐渐加重的阵发性绞痛（C错）为早期机械性肠梗阻的疼痛特点。疼痛与进食有关（D错）为消化性溃疡的腹痛特点。高热后全腹痛（E错）为原发性腹膜炎的腹痛特点。